16α位为甲基的药物是
A. 醋酸氢化可的松
B. 醋酸地塞米松
C. 醋酸泼尼松龙
D. 醋酸氟氢松
E. 醋酸曲安奈德

正确答案：B。醋酸地塞米松

解析：本题考查肾上腺糖皮质激素药地塞米松。地塞米松（B对）是在糖皮质激素分子16位引入阻碍17位的氧化代谢的甲基，使抗炎活性增加，钠潴留作用减少。醋酸氢化可的松（A错）是将氢化可的松21-OH用醋酸进行酯化制备的一种前药，氢化可的松16位无取代基。泼尼松龙（C错）是在氢化可的松的1位增加双键，16位无取代基。氟氢松（D错）是在6α-位和9α-位双氟取代的药物。曲安奈德（E错）是在9α-位引入氟原子、C16引入羟基并与C17α-羟基一道制成丙酮的缩酮，可抵消9α-氟原子取代增加钠潴留作用，糖皮质激素作用大幅度增加。